瞿麦的功效有
A. 清肺止咳
B. 利尿通淋
C. 祛风止痒
D. 破血通经
E. 利胆排石

正确答案：B、D。利尿通淋；破血通经

解析：本题考查的是瞿麦的功效。瞿麦的功效有利尿通淋（B对），破血通经（D对）。瞿麦：【功效】利尿通淋，破血通经。石韦：【功效】利尿通淋，凉血止血，清肺止咳（A错）。地肤子：【功效】利尿通淋，祛风止痒（C错）。金钱草：【功效】利水通淋，除湿退黄，解毒消肿。金钱草入肝、胆经，清利肝胆而退黄、排石（E错）。